下列罐头中可食用的是
A. 漏听
B. 超过保存期
C. 生物性胖听
D. 物理性胖听
E. 平酸腐败

正确答案：D。物理性胖听